饮用水消毒的主要目的是
A. 保持水中的余氯
B. 改善水物理性状
C. 消灭大肠杆菌
D. 杀灭病原菌，预防介水传染
E. 消灭虫卵，预防血吸虫病

正确答案：D。杀灭病原菌，预防介水传染

解析：本题考查饮用水消毒的主要目的。饮用水消毒的主要目的是切断饮用水中病原微生物的传播途径，预防传染病的发生和流行（D对ABCE错）。